属于国家重点保护野生药材物种名录二级保护药材的是
A. 乌梢蛇
B. 猪苓
C. 斑蝥
D. 天然牛黄

正确答案：A。乌梢蛇

解析：本题考查国家重点保护的野生药材名录。属于国家重点保护野生药材名录二级保护药材的是乌梢蛇（A对）。国家重点保护的野生药材名录：（1）一级保护药材名称：虎骨、豹骨、羚羊角、鹿茸（梅花鹿）。（2）二级保护药材名称：鹿茸（马鹿）、麝香（3个品种）、熊胆（2个品种）、穿山甲、蟾酥（2个品种）、哈蟆油、金钱白花蛇、乌梢蛇、蕲蛇、蛤蚧、甘草（3个品种）、黄连（3个品种）、人参、杜仲、厚朴（2个品种）、黄柏（2个品种）、血竭。（3）三级保护药材名称：川贝母（4个品种）、伊贝母（2个品种）、刺五加、黄芩、天冬、猪苓（B错）、龙胆（4个品种）、防风、远志（2个品种）、胡黄连、肉苁蓉、秦艽（4个品种）、细辛（3个品种）、紫草、五味子（2个品种）、蔓荆子（2个品种）、诃子（2个品种）、山茱萸、石斛（5个品种）、阿魏（2个品种）、连翘（2个品种）、羌活（2个品种）。斑蝥（C错）为医疗用毒性药品。